免疫是指
A. 机体识别排除抗原性异物的功能
B. 机体清除和杀伤自身突变细胞的功能
C. 机体抗感染的功能
D. 机体清除自身衰老、死亡细胞的功能
E. 机体对病原微生物的防御能力

正确答案：A。机体识别排除抗原性异物的功能

解析：免疫是人体对外来微生物和疾病如肿瘤的抵抗力。其阐明免疫系统识别抗原后发生免疫应答及其清除抗原的规律。掌握“基本概念”知识点。